糖尿病周围神经痛抑郁患者宜选用
A. 帕罗西汀
B. 阿米替林
C. 度洛西汀
D. 文拉法辛
E. 吗氯贝胺

正确答案：C。度洛西汀

解析：本题考查抑郁症的药物治疗。对糖尿病周围神经痛抑郁患者可选用度洛西汀（C对），度洛西汀为5-羟色胺及去甲肾上腺素在摄取抑制剂，是唯一可缓解糖尿病周围神经病所引起疼痛的药物。